玄参的功效是
A. 凉血，养阴
B. 凉血，截疟
C. 凉血，止痢
D. 凉血，透疹
E. 凉血，消斑

正确答案：A。凉血，养阴

解析：本题考查玄参的功效。玄参的功效是凉血，养阴（A对）。玄参【功效】清热凉血，滋阴降火，解毒散结，润肠。青蒿【功效】退虚热，凉血，解暑，截疟（B错）。白头翁【功效】清热解毒，凉血止痢（C错）。紫草【功效】凉血活血，解毒透疹（D错）。青黛【功效】清热解毒，凉血消斑（E错），定惊。